治疗肿瘤是
A. 免疫调理
B. 免疫抑制
C. 免疫调节
D. 建立免疫耐受
E. 打破免疫耐受

正确答案：E。打破免疫耐受